中药蟾酥强心作用的有效成分是
A. 吲哚碱类
B. 肾上腺素
C. 有机酸类
D. 甾醇类
E. 蟾毒类（强心甾烯蟾毒类和蟾蜍甾二烯类）

正确答案：E。蟾毒类（强心甾烯蟾毒类和蟾蜍甾二烯类）

解析：本题考查的是蟾酥的化学成分。中药蟾酥强心作用的有效成分是蟾毒类（强心甾烯蟾毒类和蟾蜍甾二烯类）（E对）。蟾酥的化学成分复杂，主要成分有蟾蜍甾二烯类、强心甾烯蟾毒类、吲哚碱类（A错）、甾醇类（D错）以及肾上腺素（B错）、多糖、蛋白质、氨基酸和有机酸（C错）等，前两类成分具有强心作用。《中国药典》以蟾毒灵、华蟾酥毒基和脂蟾毒配基为指标成分进行含量测定，要求总量不得少于7.0%。